肾功能检查的项目有
A. 血清碱性磷酸酶
B. 血清总胆固醇
C. 血清尿素氮
D. 血清总蛋白
E. 血肌酐

正确答案：C、E。血清尿素氮；血肌酐

解析：本题考查的是肾功能检查的项目。肾功能检查的项目包括血清尿素氮（C对）与血肌酐（E对）。肾功能检查的项目有：血清尿素氮（BUN）；血清肌酐（Cr）；血尿酸（UA）。血清碱性磷酸酶（A错）和血清总蛋白（D错）为肝功能检查的项目。肝功能检查的项目有：血清丙氨酸氨基转移酶（ALT）；血清天门冬氨酸氨基转移酶（AST）；血清γ-谷氨酰转移酶（GGT）；血清碱性磷酸酶（ALP）；血清总蛋白、清蛋白和球蛋白；血清总胆红素、非结合胆红素、结合胆红素。血清总胆固醇（B错）为血液生化检查的项目。血液生化检查的项目有：淀粉酶（AMY）；血清肌酸激酶及其同工酶；心肌肌钙蛋白I（cTnI）；空腹血糖（FBG）和口服葡萄糖耐量试验（OGTT）；糖化血红蛋白（HbA₁c）；总胆固醇（TC）；三酰甘油（TG）；高密度脂蛋白（HDL）；低密度脂蛋白（LDL）。